流行性斑疹伤寒的传播媒介是
A. 蜱
B. 虱
C. 蚊
D. 蚤
E. 螨

正确答案：B。虱